在酸性条件下，与铜离子生成红色螯合物的药物是
A. 异烟肼
B. 异烟腙
C. 盐酸乙胺丁醇
D. 对氨基水杨酸钠
E. 吡嗪酰胺

正确答案：A。异烟肼

解析：本题考查异烟肼。异烟肼（A对）分子中含有酰肼基，在酸性条件下，可与铜离子生成一分子螯合物。